《中华人民共和国药典》收载的处方属于
A. 法定处方
B. 医师处方
C. 协定处方
D. 急诊所方
E. 普通处方

正确答案：A。法定处方

解析：本题考查处方。《中华人民共和国药典》收载的处方为法定处方（A对）。处方按其性质分为法定处方和医师处方：法定处方：《中华人民共和国药典》、国家食品药品监督管理总局颁布标准收载的处方，具有法律的约束力。医师处方：是医师为患者诊断、治疗和预防用药所开具的处方。